更年期妇女内分泌功能衰退的主要表现是
A. 雄激素、雌激素水平的变化
B. 肾上腺激素、雄激素水平的变化
C. 雄激素、孕激素水平的变化
D. 雌激素、孕激素水平的变化
E. 孕激素、肾上腺激素水平的变化

正确答案：D。雌激素、孕激素水平的变化

解析：本题考查更年期妇女内分泌功能衰退的主要表现。更年期妇女内分泌功能衰退表现为卵泡发育中合成分泌的性激素，主要是雌激素、孕激素水平的变化（D对ABCE错），表现为黄体酮的不足，合成和分泌雌二醇能力的低落。